继发性肝癌一般不会发生变化的指标是
A. 丙氨酸氨基转移酶
B. 碱性磷酸酶
C. 谷氨酸氨基转移酶
D. 白蛋白
E. 甲胎蛋白

正确答案：E。甲胎蛋白

解析：甲胎蛋白（AFP）（E错，为本题正确答案）主要用于原发性肝癌的诊断，阳性率在70%左右；而继发性肝癌时AFP测定值90%以上为阴性，只有少数来自消化道、胰腺和生殖道的癌肿肝转移后可测得低浓度AFP阳性。丙氨酸氨基转移酶（A对）、碱性磷酸酶（B对）、谷氨酸氨基转移酶（C对）、白蛋白（D对）均是反映肝功能的指标，当发生继发性肝癌时，丙氨酸氨基转移酶、碱性磷酸酶、谷氨酸氨基转移酶因肝细胞受损被释放入血而升高，白蛋白因肝功能减退合成减少而降低。